食物中毒最常见的致病因素是
A. 有毒动植物
B. 有机磷农药
C. 有机氯农药
D. 重金属
E. 微生物

正确答案：E。微生物